与氨基糖苷类抗生素并用更易造成耳聋的药物是
A. 阿米洛利
B. 呋塞米
C. 氨苯蝶啶
D. 螺内酯
E. 乙酰唑胺

正确答案：B。呋塞米

解析：本题考查药物的联合应用。氨基糖苷类抗生素与呋塞米（B对）联用更易造成耳聋。呋塞米为强效利尿剂，阿米洛利（A错）、氨苯蝶啶（C错）、螺内酯（D错）和乙酰唑胺（E错）均为低效利尿剂，故呋塞米与氨基糖苷类抗生素联用更易造成耳聋。